直线回归与相关分析中，回归系数b=-2.689，P＜0.05，则
A. 回归直线斜率等于零
B. 相关系数r小于零
C. 相关系数r大于零
D. 截距a一定等于1
E. 截距a一定等于-1

正确答案：B。相关系数r小于零

解析：变量间关系的方向一致：对同一资料，其r与b的正负号一致。